下列药材宜用盐炙的是
A. 黄连
B. 杜仲
C. 甘遂
D. 厚朴
E. 淫羊藿

正确答案：B。杜仲

解析：本题考查的是杜仲的炮制方法。下列药材宜用盐炙的是杜仲（B对）。杜仲：【炮制方法】处方用名有杜仲、川杜仲、炒杜仲、盐杜仲。黄连（A错）：【炮制方法】处方用名有黄连、川连、酒黄连、姜黄连、吴萸连、萸黄连。甘遂（C错）：【炮制方法】处方用名有甘遂、炙甘遂、醋甘遂。厚朴（D错）：【炮制方法】处方用名有厚朴、川厚朴、姜厚朴。淫羊藿（E错）：【炮制方法】处方用名有淫羊藿、羊藿、仙灵脾、炙淫羊藿、炙羊藿。